有五个不同职业人群的冠心病患病率资料，若比较不同职业人群的冠心病患病率是否相同，统计学检验的无效假设应是
A. H0：P1=P2=P3=P4=P5
B. H0：P1=P2=P3=P4＞P5
C. H0：π1=π2=π3=π4=π5
D. H0：π1≠π2≠π3≠π4≠π5
E. H0：π1=π2≠π3=π4=π5

正确答案：C。H0：π1=π2=π3=π4=π5

解析：本题考查无效假设。有五个不同职业人群的冠心病患病率资料，若比较不同职业人群的冠心病患病率是否相同，统计学检验的无效假设应是H₀：π1=π2=π3=π4=π5=0（C对）。